年轻恒牙的可复性牙髓炎，去净腐质未露髓者，首选治疗方法为
A. 局麻下开髓引流
B. 安抚治疗
C. 间接盖髓
D. 活髓切断术
E. 局麻拔髓

正确答案：C。间接盖髓

解析：本题考查间接盖髓术的适应证。年轻恒牙的可复性牙髓炎，去净腐质未露髓者，首选治疗方法间接盖髓（C对）是将盖髓剂覆盖在接近牙髓的牙本质表面，以保存活髓，年轻恒牙牙根尚未发育完全，应尽量保存活髓以促进牙根继续发育。所以当去净腐质未露髓但已有可复性牙髓炎时，首选间接盖髓术，以促进牙髓恢复健康。局麻下开髓引流（A错）是急性化脓性牙髓炎或根尖周炎的首选方法。安抚治疗（B错）是一些深龋者，无自发痛，但有明显的激发痛，备洞过程中极敏感患牙的首选方法。活髓切断术（D错）是牙髓炎炎症累及冠髓根髓尚有活性的年轻恒牙的首选治疗方法。局麻拔髓（E错）是炎症累及全部牙髓的牙髓炎的首选治疗方法。